心动悸，脉结代的首选治疗方剂是
A. 炙甘草汤
B. 大补元煎
C. 金匮肾气丸
D. 归脾汤
E. 补中益气汤

正确答案：A。炙甘草汤

解析：炙甘草汤方含炙甘草、生姜、桂枝、人参、生地黄、阿胶、麦门冬、麻仁、大枣，以滋阴养血，益气温阳，复脉定悸，故可主治气虚血弱之“脉结代、心动悸”或虚劳肺痿（A对）。大补元煎功效为救本培元，大补气血，主治气血大亏（B错）。金匮肾气丸功效为补肾助阳，化生肾气，主治肾气不足证（C错）。归脾汤功效为益气补血，健脾养心，主治心脾气血两虚证，脾不统血证（D错）。补中益气汤功效为补中益气，升阳举陷，主治脾胃气虚证，气虚下陷证，气虚发热证（E错）。